促使乳汁从乳房内排出的内分泌激素是
A. 催乳素
B. 催产素
C. 哺乳方法不当
D. 让新生儿早吸吮多吸吮母乳
E. 喂乳前消毒乳头

正确答案：B。催产素

解析：促进乳汁从乳房内排出的内分泌激素是催产素（缩宫素）（B对）。催产素使乳腺腺泡周围的肌上皮收缩，使乳汁从腺泡、小导管进入输乳导管和乳窦而喷出乳汁。催乳素（A错）具有促进乳汁合成和启动和维持泌乳作用，不具有促进其排出功能。哺乳方法不当（C错）、让新生儿早吸吮多吸吮母乳（D错）及喂乳前消毒乳头（E错）是哺乳的方法，与题干不相干。本题主要考察催乳素及催产素的作用区别。